为了避免夜间排尿次数过多影响休息，利尿剂呋塞米宜于
A. 早晨服用
B. 餐后
C. 餐前
D. 睡前
E. 空腹

正确答案：A。早晨服用

解析：本题考查药品服用的适宜时间。为了避免夜间排尿次数过多影响休息，利尿剂呋塞米宜于早晨服用（A对）。适宜餐后（B错）服用的药有非甾体抗炎药、维生素和组胺H₂受体阻断剂。适宜餐前（C错）服用的药有胃黏膜保护药、收敛药、促胃动力药和降糖药。适宜睡前（D错）服用的药物有催眠药、平喘药、调节血脂药、抗过敏药和钙剂。适宜空腹（E错）服用的药有钙磷调节药、抗菌药物和广谱抗线虫药。